食物脂肪的消化率与下列哪项密切相关
A. 脂肪酸含量
B. 亚油酸含量
C. 熔点
D. 亚麻酸含量
E. 花生四烯酸含量

正确答案：C。熔点